对于R×C行列表资料的X²检验，其中R为行数，C为列数，则其自由度的计算公式为
A. R－1
B. C－1
C. R＋C－1
D. R×C－1
E. （R－1）（C－1）

正确答案：E。（R－1）（C－1）